在病例对照研究中，控制混杂偏倚不应采取下列哪条措施
A. 设计时制订明确的纳入和排除标准
B. 设计时进行个体或频数配比设计
C. 配比时选择尽可能多的条件加以匹配
D. 分析时采用分层分析方法
E. 分析时采用多元统计分析方法

正确答案：C。配比时选择尽可能多的条件加以匹配